联用治疗布氏杆菌感染
A. 链霉素与异烟肼
B. 链霉素与磺胺嘧啶
C. 青霉素与链霉素
D. 青霉素与磺胺嘧啶
E. 氯霉素与丙种球蛋白

正确答案：B。链霉素与磺胺嘧啶